按照《中国药典》微粒制剂指导原则靶向制剂的分类，二级靶向制剂可使药物定向作用于
A. 靶器官
B. 靶组织
C. 靶细胞
D. 靶细胞器
E. 靶细胞核

正确答案：C。靶细胞

解析：本题考查的是靶向制剂作用部位。按照《中国药典》微粒制剂指导原则靶向制剂的分类，二级靶向制剂可使药物定向作用于靶细胞（C对）。按靶向的部位，靶向制剂可分为如下几种。一级靶向制剂：系指进入靶部位的毛细血管床（AB错）释药。二级靶向制剂：系指进入靶部位的特殊细胞（如肿瘤细胞）释药，而不作用于正常细胞。三级靶向制剂：系指药物作用于细胞内的一定部位（DE错）。